易透过血脑屏障的药物具有特点为
A. 与血浆蛋白结合率高
B. 相对分子质量大
C. 极性大
D. 脂溶度高
E. 脂溶性低

正确答案：D。脂溶度高